血管内溶血导致的肾损伤类型是
A. 急性间质性肾炎
B. 急性肾小管坏死
C. 新月体型肾炎
D. 血栓性微血管病变
E. 急性肾炎

正确答案：B。急性肾小管坏死

解析：大量血管内溶血超过了结合珠蛋白的处理能力，游离血红蛋白从肾小球滤过，若血红蛋白量超过近曲小管重吸收能力，则出现血红蛋白尿（内源性肾毒性物质），导致急性肾小管坏死（B对）。急性间质性肾炎（A错）可见于药物因素、感染因素、系统性疾病、特发性。急进性肾小球肾炎、肺出血肾炎综合征、系统性红斑狼疮(SLE)、过敏性紫癜肾炎可致新月体肾炎（C错）。血栓性微血管病变（D错）可见于血栓性血小板减少性紫癜、溶血-尿毒综合征、HELLP综合征等。